平肝息风药适用于
A. 癫痫抽搐
B. 肝阳上亢
C. 瘰疬痰核
D. 小儿惊风
E. 破伤风

正确答案：A、B、D、E。癫痫抽搐；肝阳上亢；小儿惊风；破伤风

解析：本题考查的是平肝息风药的适应症。平肝息风药适用于癫痫抽搐（A对）、肝阳上亢（B对）、小儿惊风（D对）与破伤风（E对）等。凡以平抑肝阳、息风止痉为主要功效的药物，称为平肝息风药。本类药皆入肝经，多为介类或虫类药，古有介类潜阳、虫类搜风之说。具有平肝潜阳、息风止痉及镇惊安神等作用。本类药主要适用于肝阳上亢之头晕目眩、肝风内动、癫痫抽搐、小儿惊风、破伤风等证。